患者，女，34岁，受凉后出现发热、流涕、鼻塞等感冒症状，自行服用对乙酰氨基酚及其他复方感冒药。为尽快改善症状，自行加量并增加给药频次。用药2天后出现厌食、恶心和呕吐症状，诊断为对乙酰氨基酚中毒。宜选用的中毒解救药物是
A. 普萘洛尔
B. 氟马西尼
C. 谷胱甘肽
D. 乙酰半胱氨酸
E. 二巯丙醇

正确答案：D。乙酰半胱氨酸

解析：本题考查对乙酰氨基酚中毒解救。乙酰半胱氨酸（D对）可用于对乙酰氨基酚过量所致的中毒。